下列哪个不是社区卫生服务的对象
A. 健康人群
B. 亚健康人群
C. 高危人群与重点保健人群
D. 患者
E. 职业人群

正确答案：E。职业人群